参于构成胸廓上口的是
A. 胸骨柄上缘
B. 锁骨上缘
C. 胸肋关节
D. 肩锁关节
E. 肋椎关节

正确答案：A。胸骨柄上缘

解析：胸廓上口由胸骨柄上缘（A对）、第1肋和第1胸椎椎体围成。